在全身麻醉气管插管时，造成插管困难的常见原因有
A. 口底肿瘤
B. 小颌畸形
C. 颞下颌关节强直
D. 肥胖
E. 以上都是

正确答案：E。以上都是

解析：由于口腔颌面外科疾病的特点，如口底肿瘤、小颌畸形、颞下颌关节强直以及肥胖等，气管插管困难的病例比较常见。掌握“全身麻醉”知识点。